治疗虚劳心阳虚者，应首选
A. 桂枝甘草汤
B. 苓桂术甘汤
C. 拯阳理劳汤
D. 炙甘草汤
E. 人参养荣丸

正确答案：C。拯阳理劳汤

解析：拯阳理劳汤中人参、黄芪、五味子、甘草补益心气；肉桂、生姜温通心阳；白术、陈皮、当归、大枣健脾养血；全方共奏益气温阳之功，最宜治疗虚劳心阳虚证（C对）。桂枝甘草汤，其功用为补心气，温心阳，适用于治疗发汗过多，其人叉手自冒，心下悸，欲得按者（A错）。苓桂术甘汤，其功用为通阳利水，可用于治疗心悸之水饮凌心证(B错)。炙甘草汤，其功用为滋阴益气，通阳复脉，可用于治疗虚劳肺痿（D错）。人参养荣丸，其功用为益气补血，养心安神，适用于治疗心脾气血两虚证（E错）。